倒钩卡环常用于
A. 支托的同侧下方的一型观测线基牙
B. 支托的同侧下方的二型观测线基牙
C. 支托的同侧下方的三型观测线基牙
D. 支托的对侧下方的二型观测线基牙
E. 支托的对侧下方的三型观测线基牙

正确答案：B。支托的同侧下方的二型观测线基牙

解析：本题考查局部义齿固位体。倒钩卡环：常用于倒凹区在支托的同侧下方的二型观测线基牙（B对）。当有组织倒凹区无法使用杆形卡环时，更为常用。